如果利用体检资料分析不同职业人群高血压病的患病情况，这属于
A. 描述流行病学
B. 分析流行病学
C. 实验流行病学
D. 理论流行病学

正确答案：A。描述流行病学

解析：本题考查描述性研究的概念。描述性研究（A对BCD错）主要用来描述人群中疾病或健康状况及暴露因素的分布情况。它是利用常规监测记录或通过专门调查获得的数据资料，按照不同地区、不同时间及不同人群特征进行分组，描述人群中有关疾病或健康状态以及有关特征和暴露因素的分布状况，在此基础上进行比较分析，获得疾病三间分布的特征，进而获得病因线索，提出病因假设。